体内常见的高能磷酸化合物是因为其磷酸脂键水解时释放能量（kJ/mol）为
A. ＞11
B. ＞16
C. ＞21
D. ＞26
E. ＞31

正确答案：C。＞21